有下列情形之一的，不予医师执业注册，除了
A. 受吊销医师执业证书行政处罚，自处罚决定之日起至申请注册之日止不满1年的
B. 受吊销医师执业证书行政处罚，自处罚决定之日起不满2年的
C. 受吊销医师执业证书行政处罚，自处罚决定之日起满2年不满3年
D. 受刑事处罚，自刑罚执行完毕之日起至申请注册之日止不满1年的
E. 受刑事处罚，自刑罚执行完毕之日起至申请注册之日止不满2年的

正确答案：C。受吊销医师执业证书行政处罚，自处罚决定之日起满2年不满3年

解析：不予注册：有下列情形之一的，不予注册：①不具有完全民事行为能力的；②因受刑事处罚，自刑罚执行完毕之日起至申请注册之日止不满2年的；③受吊销医师执业证书行政处罚，自处罚决定之日起至申请注册之日止不满2年的；④有国务院卫生行政部门规定不宜从事医疗、预防、保健业务的其他情形的。掌握“执医概述及考试和注册”知识点。